患者不易入睡，多梦易醒，心悸健忘，神疲食少，伴头晕目眩，四肢倦怠，舌淡苔薄，脉细无力。治疗应首选
A. 酸枣仁汤
B. 归脾汤
C. 交泰丸
D. 天王补心丹
E. 安神定志丸

正确答案：B。归脾汤

解析：题中患者以不易入睡，多梦易醒为主症，故诊断为不寐。不易入睡，多梦易醒为心脾两虚，营血不足，不能奉养心神，心神不安所致，血虚不能养心则心悸健忘，气血虚弱，不能上奉于脑，清阳不升，故头晕目眩，脾气虚故食少，生化之源不足，血少气虚故神疲，四肢倦怠，舌淡苔薄，脉细无力为心脾两虚之象，故辨证为心脾气虚证，治宜补益心脾，养血安神。首选归脾汤（B对）。酸枣仁汤功能养血安神，清热除烦，常合安神定志丸治疗不寐心胆气虚证（A错）。交泰丸功能清心降火，引火归原，为不寐心神不交证的选方（C错）。天王补心丹功能滋阴养血，补心安神，为不寐心神不交偏心阴不足者的选方（D错）。安神定志丸功能镇惊安神定志，常合酸枣仁汤治疗不寐心胆气虚证（E错）。